漂白粉的杀菌效率
A. 与pH无关
B. 随pH增加而提高
C. 随pH增加而降低
D. pH为7时效率最高
E. pH为8时效率最高

正确答案：C。随pH增加而降低

解析：本题考查漂白粉的杀菌效率。漂白粉是一种常用的杀菌剂，它可以有效地杀死细菌、真菌和病毒，从而防止疾病的传播。漂白粉的杀菌效率受到多种因素的影响，其中最重要的因素是pH值。pH值是指溶液的酸碱度，它可以从0到14之间变化，其中7为中性，小于7为酸性，大于7为碱性。当pH值增加时，漂白粉的杀菌效率会降低（C对ABDE错）。这是因为漂白粉的有效成分是氯，它在酸性环境中更容易活跃，而在碱性环境中活性会受到抑制。